心理治疗的主要方法为
A. 精神分析疗法
B. 行为主义的治疗
C. 以人为中心疗法
D. A+B
E. A+B+C

正确答案：E。A+B+C

解析：心理治疗的主要方法：精神分析疗法、行为主义的治疗、以人为中心疗法。掌握“心理治疗概述”知识点。